含有芳氧羧酸结构的调血酯药物是
A. 瑞舒伐他汀钙
B. 洛伐他汀
C. 吉非罗齐
D. 非诺贝特
E. 氟伐他汀钠

正确答案：C。吉非罗齐

解析：本题考查含有芳氧羧酸结构的调血酯药物。吉非罗齐（C对）含有芳氧羧酸结构。非诺贝特（D错）含芳环但不含羧酸结构。瑞舒伐他汀（A错）含3，5二羟基羧酸，骨架为嘧啶环。氟伐他汀钠（E错）是用吲哚环替代洛伐他汀分子中的双环，并将内酯环打开与钠成盐后得到的。